急性链球菌感染后肾小球肾炎的特征性表现为
A. 弥漫性毛细血管壁增厚
B. 弥漫性系膜细胞增生及系膜基质增厚
C. 肾小球毛细血管样硬化
D. 弥漫性上皮细胞足突消失
E. 大量新月体产生

正确答案：A。弥漫性毛细血管壁增厚

解析：急性链球菌感染后肾小球肾炎属于急性弥漫性增生性肾小球肾炎，其病变特点是弥漫性毛细血管内皮细胞和系膜细胞增生。弥漫性毛细血管壁增厚（A错）主要见于膜性肾小球病（P268）。弥漫性系膜细胞增生及系膜基质增厚（B错）为系膜增生性肾小球肾炎（P272）的病变特点。肾小球毛细血管样硬化（C错）为局灶性节段性肾小球硬化（P270）的病变特点。弥漫性上皮细胞足突消失（D错）为微小病变性肾小球肾炎（P270）的病变特点。大量新月体产生（E错）为急进性肾小球肾炎（P267）的病变特点。按八版病理学观点，本题无正确答案，原答案为A。